女性，26岁。因甲状腺功能亢进行甲状腺切除，术后第二天出现手足抽搐。采用的治疗方法是
A. 颈部理疗
B. 口服甲状腺素片
C. 口服复方碘化钾溶液
D. 气管切开
E. 静脉注射10%葡萄糖酸钙

正确答案：E。静脉注射10%葡萄糖酸钙

解析：患者甲状腺切除术后出现手足抽搐由低血钙所致。静脉注射10%葡萄糖酸钙（E对），可迅速提高血浆中游离钙离子的浓度，稳定神经细胞及肌膜，缓解手足抽搐。颈部理疗（A错）可提高局部新陈代谢速率，促进伤口愈合；口服甲状腺素片（B错）用于治疗术后甲减；口服复方碘化钾溶液（C错）为甲亢术前准备及甲状腺危象的治疗措施之一；气管切开（D错）为治疗上呼吸道梗阻的方法之一，以上四种方法，对低血钙性手足抽搐无效。